9岁，学生，1月底因突起高热、剧烈头痛、恶心伴非喷射性呕吐1次入院。体检：神清，全身皮肤散在瘀点、瘀斑，颈项抵抗，心率120次/分，两肺无异常，腹软无压痛。化验检查：血白细胞计数20×10/L，中性粒细胞0.89，淋巴细胞0.05，单核细胞0.06最可能的诊断是
A. 伤寒
B. 流行性脑脊髓膜炎
C. 结核性脑膜炎
D. 流行性乙型脑炎
E. 病毒性脑炎

正确答案：B。流行性脑脊髓膜炎

解析：9岁患儿，1月底（流脑高发季节）突起高热、剧烈头痛、恶心伴非喷射性呕吐1次入院（流脑败血症期典型临床表现），体检：神清，全身皮肤散在瘀点、瘀斑，颈项抵抗，心率120次/分，两肺无异常，腹软无压痛（流脑常见体征）；化验检查：血白细胞计数20×10⁹/L（正常参考值4～10×10⁹/L），中性粒细胞0.89（正常参考值0.5～0.7），淋巴细胞0.05，单核细胞0.06，根据患儿临床表现及实验室结果，最可能的诊断是流行性脑脊髓膜炎（B对），简称为流脑，其主要临床表现是突发高热、剧烈头痛、频繁呕吐，皮肤黏膜瘀点、瘀斑及脑膜刺激征，严重者可有败血症休克和脑实质损害，常可危及生命。伤寒（A错）多表现为长期稽留热，表情淡漠，相对缓脉，但无脑膜刺激征（P149）。结核性脑膜炎起病缓慢，多于1～2周非特异性感染症状后，出现脑膜刺激征（C错）。流行性乙型脑炎（P86）（D错）与病毒性脑炎（E错）均为病毒感染，常表现为外周血白细胞轻度升高，且以淋巴细胞增多为主。